以下关于基层下疱的描述中，错误的是
A. 可见于多形渗出性红斑
B. 疱在基底层之下
C. 可见于天疱疮
D. 基底细胞变性
E. 上皮全层与固有层分离

正确答案：C。可见于天疱疮

解析：基层下疱：疱在基底层之下，基底细胞变性，使上皮全层与固有层分离。见于黏膜良性类天疱疮、多形渗出性红斑。掌握“口腔黏膜基本病理变化”知识点。